热结肠胃，痰食壅积，以致经脉阻滞，气血不能畅达，致倦怠懒言，身体羸瘦，脉象沉细。此为
A. 真热假寒
B. 真实假虚
C. 真虚假实
D. 不虚不实
E. 真寒假热

正确答案：B。真实假虚

解析：真实假虚，是指本质为实证，反见某些虚赢现象的证候。其病机是由于热结肠胃、痰湿壅积、湿热内蕴、瘀血停蓄等，邪气大积大聚，以致经脉阻滞，气血不能畅达，因而表现出一些类似虚证的假象。肠热腑实证，是指里热炽盛，腑气不通，以发热、大便秘结、腹满硬痛为主要表现的实热证候。面色苍白，四肢厥冷，精神萎顿，均多因阳气虚衰所致的虚寒证候。肠热腑实证候不兼见面色苍白，四肢厥冷，精神萎顿。故其病机为真实假虚（B对）